脊髓下端上移至第1腰椎的年龄是
A. 6个月
B. 1岁
C. 2岁
D. 4岁
E. 3岁

正确答案：D。4岁

解析：随着小儿的生长，脊髓也会相应的增长，4岁是脊髓下端上移至第1腰椎的年龄（D对）。